治疗感染性休克，应选用
A. 后马托品
B. 托吡卡胺
C. 普鲁苯辛
D. 山莨菪碱
E. 东莨菪碱

正确答案：D。山莨菪碱

解析：山莨菪碱应用于感染中毒休克等（D对）。后马托品用于散瞳验光及检查眼底（A错）。托吡卡胺用于散瞳检查眼底，验光配镜，虹膜状体炎（B错）。普鲁苯辛用于胃和十二指肠溃疡的辅助治疗，亦用于胃炎、胰腺炎、胆汁排泄障碍、多汗症、孕妇呕吐及遗尿（C错）。东莨菪碱用于晕车晕船，也可用于妊娠或放射病所致呕吐，此外还用于帕金森病（E错）。